腹膜为全身面积最大的浆膜，薄而光滑，呈半透明状，壁腹膜和脏腹膜相互移行围成一浆膜腔，称腹膜腔。腹膜有分泌、吸收、支持、固定、修复和防御等功能。腹膜从腹、盆壁移行于脏器或脏器间相互移行形成许多结构，主要有网膜、系膜、韧带和陷凹等。属于腹膜间位器官的是
A. 肝
B. 乙状结肠
C. 卵巢
D. 肾
E. 胰

正确答案：A。肝

解析：肝(A对)于腹膜间位器官，乙状结肠(B错)和卵巢(C错)属于腹膜内位器官，肾(D错)和胰(E错)属于腹膜外位器官。